下列有关涎石病的描述中，正确的是
A. 好发于女性
B. 老年人较多见
C. 反复发作的炎症
D. 涎石最好发腮腺
E. 以上说法均正确

正确答案：C。反复发作的炎症

解析：涎石病患者性别无明显差异，中青年为多见。病期短者数日，长者数年甚至数十年。掌握“涎石病及下颌下腺炎”知识点。